肾综合征出血热的“三大”主征
A. 发烧，休克，少尿
B. 出血，休克，肾损害
C. 发烧，出血，肾损害
D. 发烧，出血，“三痛”
E. 休克，少尿，“三痛”

正确答案：C。发烧，出血，肾损害